四缝穴的位置在
A. 手第一至五指间，指蹼缘后方赤白肉际处
B. 手第一至四指掌侧，指骨关节横纹中点处
C. 手第二至五指掌侧，近端指骨关节横纹中点处
D. 手第一至四指掌侧，近端指骨关节横纹中点处
E. 手第二至五指掌侧，掌指关节横纹中点处

正确答案：C。手第二至五指掌侧，近端指骨关节横纹中点处

解析：该题考查四缝穴的定位。四缝穴位于鼻在第2至第5指掌侧，近端之间关节的中央，一手4穴，左右共8穴（C对ABDE错）。